病例对照研究资料分析中，均衡性检验的目的是
A. 分析暴露与疾病的统计学关联
B. 描述研究对象的一般特征
C. 考核病例组和对照组资料之间的可比性
D. 检验病例与对照组的样本量是否充足
E. 检验暴露与疾病的关联强度

正确答案：C。考核病例组和对照组资料之间的可比性

解析：本题考查均衡性检验的目的。均衡性检验即比较病例组与对照组某些基本特征是否相似或齐同，目的是检验两组的可比性（C对ABDE错）。